患者，男，72岁，素体气虚，复感外邪，恶寒较重，无发热，鼻塞流涕，头痛无汗，肢体倦怠乏力，咳嗽咯痰无力，舌质淡，苔薄白，脉浮。诊断为气虚感冒。据此判断此为气的何种功能减退所致
A. 推动作用
B. 温煦作用
C. 防御作用
D. 固摄作用
E. 中介作用

正确答案：C。防御作用

解析：气的防御功能指的是气既能护卫肌表，防御外邪入侵，同时也可以祛除侵入人体内的病邪。若气的防御功能低下，邪气易于入侵而发生疾病，并且不容易祛邪外出。病例中患者年龄72岁，正气虚衰，防御能力下降，邪气容易入侵人体，出现感冒的症状，并且感冒之后正气祛邪外出的能力减弱，故无发热、无汗（C对）。气的推动（A错）作用减弱将会出现激发、兴奋作用减退，精气血津液的生成、输布、代谢缓慢，运行不畅，精神抑制，可见精瘀、血瘀、痰饮、精神委顿等。气的温煦（B错）作用减退，产热减少，可见虚寒性病变，表现为畏寒肢冷，脏腑生理活动减弱，精气血津液代谢减弱、运行迟缓等。气的固摄（D错）作用减弱，则有可能导致体内液态物质的大量丢失。例如，气不摄血引起各种出血证，气不摄津引起自汗、多尿、小便失禁、流涎、呕吐清水、泄泻滑脱等证，气不固精可以引起遗精、滑精、早泄等病症。气的中介作用（E错）是指气能感应传导信息以维系机体的整体联系，气充斥于人体各脏腑组织器官之间，是感应传递信息之载体，彼此相互联系的中介。